不需要进行治疗药物监测的是
A. 治疗指数低的药物
B. 安全范围窄的药物
C. 毒副作用强的药物
D. 胃肠不吸收的药物
E. 具非线性药动学特征的药物

正确答案：D。胃肠不吸收的药物